依评价主体的不同，医德评价可分为两种，它们是
A. 病人评价和家属评价
B. 院长评价和同事评价
C. 社会评价和自我评价
D. 外在评价和自我评价
E. 社会评价和内在评价

正确答案：C。社会评价和自我评价